形成瘤的主要病机是
A. 邪气偏盛
B. 阴阳失调
C. 阴毒结聚
D. 正气不足
E. 经络阻塞

正确答案：A。邪气偏盛

解析：该题考查瘤的病因病机。形成瘤的主要病机是邪气偏盛（A对）。